心电图示心率180次/分，QRS波群时间0.10秒，R-R间期绝对匀齐最可能的诊断是
A. 房室交界性逸搏心律
B. 阵发性室上性心动过速
C. 阵发性室性心动过速
D. 窦性心动过速
E. 心房颤动

正确答案：B。阵发性室上性心动过速

解析：室上性心动过速的心电图特点是①连续3次或3次以上的房性或交界性期前收缩，频率大多为150～250次/min，节律一般规则。②QRS波群形态基本正常，时间≤0.10s。伴心室内差异传导或原有束支阻滞时QRS波群增宽，多呈束支阻滞图形。③ST-T可无变化，也可见ST段下移和T波倒置（B对）。交界性逸搏见于窦性停搏及三度房室传导阻滞等。其心电图特点为：长间歇后出现一个QRS波群，QRS呈室上性，其形态与窦性QRS波群相同或略有差别。连续出现3次或3次以上的交界性逸搏称交界性逸搏心律，频率为40～60次/min，慢而规则（A错）。室性心动过速的心电图特点是：①连续3次或3次以上室性期前收缩，频率多在100～250次/min，节律大致规则，可略有不齐。②QRS波群宽大畸形，时间≥0.12s，T波与QRS波群主波方向相反。③房室分离。④心室夺获与室性融合波（C错）。窦性心动过速的心电图特点是①窦性心律。②心率100～160次/min。③有时可伴有继发性ST-T改变（D错）。心房颤动心电图特点是：①f波∶P波消失，代以大小不等、形态不同、间距不匀齐的房颤波（f波），f波频率为350～600 次/min。通常在V₁导联最清楚，其次为Ⅱ、Ⅲ、aVF导联。②RR间期绝对不齐，即心室律绝对不规则。③QRS波群形态正常，有时可因室内差异传导或伴室内传导阻滞而增宽（E错）。